骨质
A. 由骨密质构成
B. 由骨松质构成
C. 由骨小梁构成
D. 骨密质配布于骨的表面
E. 无

正确答案：D。骨密质配布于骨的表面

解析：骨质由骨组织构成，按结构可分为密质和松质（AB错）。骨密质结构致密，抗压抗扭曲性强，分布于骨的表面（D对）。骨松质呈海绵状，由相互交织的骨小梁排列而成（C错），配布于骨的内部。